生产工艺过程中的有害因素不包括
A. 铅
B. 炭疽杆菌
C. 煤尘
D. 微波
E. 劳动强度过大

正确答案：E。劳动强度过大